男，35岁。搬重物时突然出现腰背部疼痛伴右下肢放射痛2小时。查体：下腰部压痛，右下肢直腿抬高试验（+），右侧足背外侧感觉减弱，右足趾跖屈肌力减弱，右侧跟腱反射减弱，Babinski征（-）。该患者疾病可能受累的节段是
A. L4～5
B. L5～S1
C. L2～3
D. L1～2
E. L3～4

正确答案：B。L5～S1

解析：患者青年男性，搬重物时（腰椎间盘突出症常见诱因）突然出现腰背部疼痛伴右下肢放射痛（腰椎间盘突出症常见症状）。查体：下腰部压痛，右下肢直腿抬高试验（+）（腰椎间盘突出症常见体征），右侧足背外侧感觉减弱，右足趾跖屈肌力减弱，右侧跟腱反射减弱（L5～S1受损表现）；结合患者临床表现考虑腰椎间盘突出症，结合‘表67-1腰神经根病的神经定位’定位于L5～S1（B对）。L2损伤主要表现为：大腿前中部感觉障碍，及髂腰肌运动障碍，L1～2（D错）、L2～3（C错）；L4损伤主要表现为内踝感觉障碍，足背伸肌运动障碍，L4～5（A错）L3～4（E错）。